天王补心丹与朱砂安神丸组成中均含有的药物有
A. 酸枣仁
B. 炙甘草
C. 玄参
D. 黄连
E. 生地黄

正确答案：E。生地黄

解析：本题考查天王补心丹与朱砂安神丸的药物组成。天王补心丹与朱砂安神丸均为安神剂，天王补心丹由人参、茯苓、玄参、丹参、桔梗、远志、当归、五味、麦门冬、天门冬、柏子仁、酸枣仁、生地黄构成，朱砂安神丸由朱砂、黄连、炙甘草、生地黄、当归构成，两者均含有的药物为生地黄（E对）。酸枣仁仅为天王补心丹的药物组成（A错）。炙甘草仅为朱砂安神丸的药物组成（B错）。玄参仅为天王补心丹的药物组成（C错）。黄连仅为朱砂安神丸的药物组成（D错）。记忆：补心丹用柏枣仁，二冬生地当归身，三参桔梗朱砂味，远志茯苓养心神。趣记：朱砂安神丸，老朱当皇帝。――朱当黄地。